婴儿创伤性溃疡最好发的部位是
A. 舌缘
B. 颊黏膜
C. 舌系带附近
D. 前庭沟黏膜
E. 舌背

正确答案：C。舌系带附近

解析：本题考查婴儿创伤性溃疡最好发的部位。婴幼儿的创伤性溃疡最好发于舌系带附近（C对）主要有两个原因：一是新萌出的下颌乳中切牙的锐利切缘不断与舌系带摩擦而发生溃疡；另一个原因是舌系带过短，且偏近舌尖，或下颌的乳中切牙萌出过早，即使是正常的吮乳动作也可造成创伤。舌缘（A错）和颊黏膜（B错）的创伤性溃疡多是由于后牙咬伤所致，而婴儿常只有最早萌出的下前牙，故不会咬伤舌缘和颊粘膜。前庭沟黏膜（D错）处的刺激主要来源于不良修复体，例如可摘局部义齿的基托刺激压迫导致创伤性溃疡，婴幼儿一般少有修复体。舌背（E错）损伤常见于有咬舌习惯者，伸舌时上下前牙咬伤舌背粘膜，婴儿常只有最早萌出的下前牙，不会咬伤舌背。